手太阴肺经在上肢的分布是
A. 内侧前缘
B. 外侧前缘
C. 内侧中行
D. 外侧后缘
E. 内侧后缘

正确答案：A。内侧前缘

解析：该题考查十二经脉的分布规律。上肢内侧前缘为手太阴肺经（A对），外侧前缘为手阳明大肠经（B错），上肢内侧中行为手厥阴心包经（C错），上肢外侧后缘为手太阳小肠经（D错），上肢内侧后缘为手少阴心经（E错）。记忆：阳经，前中后：阳少太。阴经，前中后：太厥少。